土壤的主要污染物是
A. 粪便、化肥、农药
B. 厌氧杆菌、寄生虫、农药
C. 有毒化学物质、放射性物质、物理污染物质、生物污染物质
D. 致癌物、致畸物、致突变物
E. 厌氧杆菌、寄生虫卵、放射性物质

正确答案：C。有毒化学物质、放射性物质、物理污染物质、生物污染物质

解析：本题考查土壤的主要污染物。土壤污染是指土壤中污染物的含量超过规定的标准，从而影响土壤的质量，破坏土壤的生态环境，并对人类健康和生态环境造成危害。土壤污染的主要污染物是有毒化学物质、放射性物质、物理污染物质和生物污染物质（C对ABDE错）。